患者1年前，运动时上前牙碰伤，当时有咬物疼痛，无其他不适，未治疗。以后发现牙冠变色，其原因可能为
A. 色素沉着
B. 牙髓坏死
C. 牙髓变性
D. 牙本质变性
E. 以上都不是

正确答案：B。牙髓坏死

解析：本题考查牙震荡。患者1年前，运动时上前牙碰伤，当时有咬物疼痛，无其他不适，未治疗。以后发现牙冠变色，其原因可能为牙髓坏死（B对）。患者一年前，运动时上前牙碰伤，当时有咬物疼痛，无其他不适，可知患牙当时有牙震荡；患牙未治疗，一年后出现牙冠变色，可能是因牙髓坏死引起的，牙髓组织坏死后红细胞破裂使血红蛋白分解产物进入牙本质小管，从而导致了牙冠变色。色素沉着主要由附着在牙表面的菌斑、产色素细菌、饮料、食物等引起，为外源性着色，一般通过刷牙或洁牙即可去除，牙冠本身并没有颜色改变（A错）。牙髓变性主要是由牙髓组织受到长期慢性刺激，或因根尖孔缩窄，牙髓供血不足，使牙髓组织代谢障碍而出现的缓慢的退行性变，一般不会出现牙冠变色（C错）。牙本质变性主要表现为牙本质的反应性改变，主要有修复性牙本质、透明牙本质和死区的形成，并不会出现牙冠变色（D错）。